受理医师执业注册申请的卫生行政部门对不符合条件不予注册的，书面通知申请人并说明理由的期限是应当自收到申请之日起
A. 10日内
B. 15日内
C. 30日内
D. 60日内
E. 90日内

正确答案：C。30日内

解析：受理申请的卫生行政部门对不符合条件不予注册的，应当自收到申请之日起30日内书面通知申请人，并说明理由。掌握“执医概述及考试和注册”知识点。